某女，72岁。左下肢静脉曲张病史20年，平素腰膝酸软。6天前左下肢静脉曲张处出现青紫色，呈条索状凸起，疼痛难忍，行走困难，由家属搀扶走入诊室。大便干结3天。医师检查：左下肢红肿，大小约5cm×15cm，体温38.9℃。舌红、苔黄、脉弦数。证属血热毒盛、脉络瘀阻。处以丹参、虎杖、大青叶、络石藤、金银花、川牛膝、防己、大血藤、生甘草。方中所用大血藤除能清热解毒、祛风通络外，又能
A. 行气止痛
B. 活血止痛
C. 麻醉止痛
D. 消肿止痛
E. 缓急止痛

正确答案：B。活血止痛

解析：本题考查大血藤的功效。方中所用大血藤除能清热解毒、祛风通络外，又能活血止痛（C对）。大血藤【功效】清热解毒，活血止痛，祛风通络。甘遂【功效】泻水逐饮，消肿散结（A错）。连钱草【功效】利湿通淋（B错），清热解毒，散瘀消肿。射干【功效】清热解毒，祛痰利咽（D错），散结消肿。地锦草【功效】清热解毒，活血止血（E错），利湿退黄。